对关于正中关系检查描述正确的是
A. 又称正中（牙合）
B. 亦称正中关系（牙合）
C. 亦称牙尖交错（牙合）
D. 髁突位于关节窝中部
E. 是一个准确可重复的位置

正确答案：E。是一个准确可重复的位置

解析：正中关系检查：检查患者在反复咬合时颌位关系记录是否准确、可重复，（牙合）托是否有前移、翘动或扭动。术者可将两小指指肚向前插入患者两侧外耳道内，感觉并比较咬合时两侧髁突向后撞击力度是否等量。还可将两示指放于颞部，感觉并比较咬合时两侧颞肌中份是否收缩有力和对称。如果感觉两侧髁突撞击和颞肌收缩不明显，则可能下颌未退回到正中关系位。如果两侧髁突撞击和颞肌收缩不对称，则可能下颌发生了偏斜。掌握“全口义齿颌位关系及上（牙合）架”知识点。